髓室底上，为髓室与根管的移行处的是
A. 髓室顶
B. 髓室底
C. 髓室高度
D. 根管口
E. 髓角

正确答案：D。根管口

解析：根管口：位于髓室底上，为髓室与根管的移行处。掌握“髓腔各部分名称、增龄性变化及临床意义”知识点。